人工牙面过小、低、关系不好，义齿恢复的垂直距离过低，最终导致的是
A. 义齿弹跳
B. 义齿翘动
C. 义齿咀嚼功能差
D. 义齿基托与组织不密合
E. 义齿摆动

正确答案：C。义齿咀嚼功能差

解析：人工牙面过小、低、关系不好，义齿恢复的垂直距离过低，都可降低咀嚼效能。掌握“局部义齿修复后出现的问题及处理”知识点。